男，68岁。活动后心悸、气短4年，突发憋喘1小时来诊。高血压病史10年余，平时血压波动于130～150/70～90mmHg。查体：BP230/100mmHg，端坐位，双肺底可闻及少量湿性啰音，心率114次/分。该患者最适宜的治疗是
A. 口服阿替洛尔
B. 口服硝苯地平
C. 口服哌唑嗪
D. 肌注利血平
E. 静脉滴注硝普钠

正确答案：E。静脉滴注硝普钠

解析：患者老年男性，有高血压病史，平时血压波动于130～150/70～90mmHg，现突发憋喘，端坐位，双肺底可闻及少量湿性啰音，提示急性左心衰竭，且BP210/120mmHg（≥180/120mmHg），考虑诊断为高血压急症伴急性左心衰竭。此时该患者最适宜的治疗是静脉滴注硝普钠（E对）。硝普钠为动、静脉扩张剂，起效快，可迅速降低血压，适用于各种高血压急症。阿替洛尔（A错）属于选择性β₁受体阻滞剂、硝苯地平（B错）属于二氢吡啶类钙通道拮抗剂，都可作为高血压的常规用药，但一般不用高血压急症的治疗。哌唑嗪（C错）为α₁受体阻滞剂，因其副作用较多，目前不主张单独使用（P255）。肌注利血平（D错）的降压作用起效缓慢，如果短时间内反复注射可导致难以预测的蓄积效应，发生严重低血压，引起明显嗜睡反应，干扰对神智的判断（P257-P258）。